属于纤溶异常的实验室检査是
A. 血vWF测定
B. PF3有效性测定
C. 血栓素B₂测定
D. 血PC测定
E. 血D-二聚体测定

正确答案：E。血D-二聚体测定

解析：血浆D-二聚体（E对）是交联纤维蛋白在纤溶系统作用下产生的可溶性降解产物，为一个特异性的纤溶过程标记物。血小板黏附需要血小板上的糖蛋白（GP）、内皮下成分（胶原纤维）、及血管性血友病因子（vWF）的参与（A错），故血vWF测定属于血小板粘附的测定。凝血酶原激活物为Xa、V、Ca²⁺和PF₃（血小板第3因子，为血小板膜上的磷脂）复合物，PF3有效性测定（B错）属于凝血酶原激活物的测定。血栓素A₂具有促进血小板凝聚及血管收缩作用，TXA₂生物半衰期仅30s，迅速转化为无活性的血栓素B₂（TXB₂），故血栓素B₂测定（C错）属于血小板聚集的测定。蛋白C系统具有抗凝作用，蛋白C系统由蛋白C（PC）、蛋白S（PS）、血栓调节蛋白（TM）等组成，血PC测定（D错）属于抗凝的实验室检查。